引起青霉素过敏的主要原因是
A. 青霉素本身为过敏源
B. 合成、生产过程中引入的杂质青霉噻唑等高聚物
C. 青霉素与蛋白质反应物
D. 青霉素的水解产物
E. 青霉素的侧链部分结构所致

正确答案：B。合成、生产过程中引入的杂质青霉噻唑等高聚物

解析：本题考查β-内酰胺类抗菌药物。青霉素过敏的主要原因是合成、生产过程中引入的杂质青霉噻唑等高聚物（B对）。青霉噻唑与蛋白质多肽结合,生成的青霉噻唑蛋白是主要抗原。